既解表化湿，又理气和中的中成药是
A. 藿香正气片
B. 六一散
C. 砂仁驱风油
D. 十滴水
E. 复方草豆蔻酊

正确答案：A。藿香正气片